根茎簇生多数细根，多编成辫状的药材
A. 土茯苓
B. 紫菀
C. 黄精
D. 泽泻
E. 白前

正确答案：B。紫菀

解析：本题考查的是紫菀药材的性状鉴别。根茎簇生多数细根，多编成辫状是紫菀（B对）。紫菀：【性状鉴别】药材根茎呈不规则块状，大小不一，顶端有茎、叶的残基；质稍硬。根茎簇生多数细根，多编成辫状；表面紫红色或灰红色，有纵皱纹。质较柔韧。气微香，味甜、微苦。土茯苓（A错）：【性状鉴别】药材略呈圆柱形，稍扁或呈不规则条块，有结节状隆起，具短分枝。表面黄棕色或灰褐色，凹凸不平，有坚硬的须根残基，分枝顶端有圆形芽痕，有的外皮现不规则裂纹，并有残留的鳞叶。质坚硬。切片呈长圆形或不规则形，边缘不整齐；切面类白色至淡红棕色，粉性，可见点状维管束及多数小亮点；质略韧，折断时有粉尘飞扬，以水湿润后有黏滑感。气微，味微甘、涩。黄精（C错）：【性状鉴别】药材大黄精呈肥厚肉质的结节块状。表面淡黄色至黄棕色，具环节，有皱纹及须根痕，结节上侧茎痕呈圆盘状，周围凹入，中部突出。质硬而韧，不易折断，断面角质，淡黄色至黄棕色。气微，味甜，嚼之有黏性。泽泻（D错）：【性状鉴别】药材呈类球形、椭圆形或卵圆形。表面淡黄色至淡黄棕色，有不规则的横向环状浅沟纹和多数细小突起的须根痕，底部有的有瘤状芽痕。质坚实，断面黄白色，粉性，有多数细孔。气微，味微苦。白前（E错）：【性状鉴别】药材柳叶白前根茎呈细长圆柱形，有分枝，稍弯曲。表面黄白色或黄棕色，节明显，顶端有残茎。质脆，断面中空，习称“鹅管白前”。节处簇生纤细弯曲的根，有多次分枝呈毛须状，常盘曲成团。气微，味微甜。